九味羌活汤的组成药物中含有
A. 黄连
B. 杏仁
C. 细辛
D. 熟地黄
E. 石膏

正确答案：C。细辛

解析：本题考查九味羌活汤的组成，属于记忆内容。九味羌活汤功效发汗祛湿，兼清里热，由羌活、防风、苍术、细辛、川芎、香白芷、生地黄、黄芩、甘草组成。细辛是九味羌活汤的组成药物之一（C对）。记忆：九味羌活防风苍，辛芷芎草芩地黄，发汗祛湿兼清热，分经论治变通良。